妊娠足月，胎位下移，腰腹阵痛，有便意或见红者是
A. 临产
B. 试胎
C. 弄胎
D. 分娩
E. 以上均非

正确答案：A。临产

解析：孕妇分娩，又称临产，分娩前多有征兆，如胎位下移，小腹坠胀，有便意感，或阴道有少量血水排出，又称“见红”（A对）。试胎（B错），又称试月，指妊娠八九个月时，或腹中痛，痛定仍然如常者。弄胎（C错），指妊娠若月数已足，腹痛或作或止，腰不痛者。分娩（D错）是指妊娠满28周及以后的胎儿及其附属物，从临产发动至母体全部娩出的过程。